28岁，产后8个月，经期延长，基础体温呈双相，但高温相下降迟缓。应考虑诊断为
A. 妊娠
B. 无排卵型功血
C. 黄体功能不足
D. 子宫内膜不规则脱落
E. 稽留流产

正确答案：D。子宫内膜不规则脱落